病原体侵入人体后引起疾病的主要因素是
A. 机体的保护性免疫
B. 机体的天然屏障作用
C. 病原体的毒力与数量
D. 病原体的侵入途径与特异性定位
E. 病原体的致病力与机体的免疫机能

正确答案：E。病原体的致病力与机体的免疫机能

解析：病原体侵入机体后能否致病，取决于病原体的致病能力、宿主的免疫机能和外界环境因素三个方面（D对）。机体的保护性免疫属于机体免疫应答的一类（A错）。机体的天然屏障作用属于机体的免疫应答，对感染过程的表现和转归起着重要的作用（B错）。病原体的毒力、数量都属于病原体的致病力（C错）。病原体的侵入途径与特异性定位影响的是传染病的发病机制（D错）。